甲型肝炎最有效的预防措施是
A. 隔离患者
B. 搞好三管一灭
C. 注射甲肝疫苗
D. 注射丙种球蛋白
E. 流行期间服用板蓝根

正确答案：C。注射甲肝疫苗

解析：甲型肝炎疫苗主要用于幼儿，学龄前儿童及其他高危人群，注射甲肝疫苗（C对）获得甲肝抗体后，可产生稳固的免疫力，二次感染者少见，为甲型肝炎最有效的预防措施。隔离患者（A错）可阻断传染源，但不是预防措施；搞好三管一灭（B错）由于各地条件的差异，很难真正切断传播途径；注射丙种球蛋白（D错）主要用于接触甲型肝炎患者的易感儿童；流行期间服用板蓝根（E错）不会产生甲肝抗体，不能预防甲型肝炎。